某女，35岁。胸胁胀痛，咽中异物感，时咳，痰少黏稠，舌淡红，脉沉弦。基于五脏的生理功能分析，其病变属于
A. 肺司呼吸失常
B. 脾主运化失常
C. 肾主藏精失常
D. 心主血脉失常
E. 肝主疏泄失常

正确答案：E。肝主疏泄失常

解析：本题考查的是五脏的生理功能。胸胁胀痛，咽中异物感，时咳，痰少黏稠，舌淡红，脉沉弦。基于五脏的生理功能分析，其病变属于肝主疏泄失常（E对）。胀痛：指疼痛伴有胀满或胀闷。多为气滞所致，在很多部位都可以出现，以胸脘、腹部为最多。如胃脘胀痛，则为中焦寒凝气滞；胸胁胀痛，则为肝郁气滞等。头部胀痛，则多见于肝阳上亢或肝火上炎的病证。肺主气，司呼吸（A错）：（1）肺主呼吸之气：肺是体内外气体交换的场所，人体通过肺，从自然界吸入清气，呼出体内的浊气，吐故纳新，使体内外的气体不断交换，从而保证了人体新陈代谢的正常进行。（2）肺主一身之气：肺吸入的清气与脾胃运化的水谷精气，在胸中相合生成宗气，贯心脉以行心血；并且，肺气的升降出入运动对全身气机具有调节作用，故“诸气者，皆属于肺”。脾主运化（B错）：（1）运化水谷精微，是指脾对饮食物的消化和水谷精微的吸收、转输、布散的作用。饮食物由胃受纳腐熟，必须依赖于脾的运化功能，才能将水谷转化为精微物质，转输到心肺，布散于全身，从而使各个脏腑、组织、器官得到充足的营养，并通过心肺的作用化生气血，故“脾为后天之本，气血生化之源”。脾气的运化功能正常，称为“脾气健运”减退；其失常，称为“脾失健运”，则可影响饮食物的消化和精微的吸收而出现腹胀、便溏、食欲不振，乃至倦怠、消瘦等精气血生化不足的病变。（2）运化水液，是指脾对水液的吸收、转输和布散作用。水饮的消化吸收亦在胃、小肠和大肠中进行，但又必须经脾气的推动、激发作用，才能完成。脾气转输津液，上输于肺，通过肺气宣降输布全身；并“以灌四傍”，向四周布散，发挥其滋养濡润脏腑的作用。脾气健运，津液化生充足，输布正常，脏腑形体官窍得养。脾失健运，或津液生成不足，或津液输布障碍，而见水湿痰饮等。如《素问·至真要大论》说：“诸湿肿满，皆属于脾。”肾藏精（C错），是指肾对精气具有封藏作用。肾所藏之精包括“先天之精”和“后天之精”。所谓“先天之精”，禀受于父母的生殖之精，与生俱来，是构成胚胎发育的原始物质，并具有生殖、繁衍后代的基本功能。所谓“后天之精”，包括水谷精气和五脏六腑之精，即出生之后，来源于饮食物，通过脾胃运化功能而生成的水谷之精气；分布于脏腑而成为五脏六腑之精，以发挥滋养濡润作用。“先天之精”与“后天之精”的来源不同，但同藏于肾而构成肾中精气。心主血脉（D错）：（1）心有推动血液在脉管内运行的作用。心、脉和血液循行在体内构成一个相对的独立系统。心主血脉的关键是心脏正常搏动。心脏的正常搏动，有赖于心气、心阳的推动和温煦作用，以及心血、心阴的营养和滋润作用，从而维持正常的心力、心率、心律，维持血液在脉内正常运行。例如，心的气、血、阴、阳不足或失调，皆可影响心脏的正常搏动而出现异常现象。（2）心对血液的生成也有一定的作用。饮食物经过脾胃的消化吸收，将精微上输于心肺，经心肺的气化作用，化赤而形成血液。因此，心脏正常搏动和血液正常运行，也有赖于全身血液充盈。例如，心血不足，可见心悸、脉数等症。